男，25岁，间断咳嗽、咳痰带血1个月，乏力、纳差伴尿少、水肿1周。实验室检查：血WBC8.6×10⁹/L，血红蛋白90g/L，尿蛋白（++），尿沉渣镜检红细胞8～10/HP，血肌酐268μmol/L，尿素氮22.6mmol/L，抗肾小球基底膜抗体（+），ANCA阴性。最可能的免疫病理所见是
A. 无或仅微量免疫复合物
B. IgG和C₃呈颗粒状沉积于系膜区及毛细血管壁
C. IgG、IgA、IgM、C₃呈多部位沉积
D. IgG和C₃呈细颗粒状沿毛细血管壁沉积
E. IgG和C₃呈线条状沉积于毛细血管壁

正确答案：E。IgG和C₃呈线条状沉积于毛细血管壁

解析：I型，又称抗肾小球基底膜（GBM）型肾小球肾炎，由于抗GBM抗体与GBM抗原相结合激活补体而致病。I型lgG及C3呈光滑线条状沿肾小球毛细血管壁分布（E对）。